反复输血后，可出现移植器官与受者血管接通后数分钟至24小时内发生的排斥反应，移植术后，移植器官发生不可逆性缺血、变性和坏死。这种移植排斥反应的类型是
A. 超急排斥
B. 急性排斥
C. 慢性排斥
D. CVHR
E. 以上都不是

正确答案：A。超急排斥

解析：超急性排斥反应是在移植器官与受者血管接通后数分钟至24小时内发生的排斥反应，见于反复输血、多次妊娠、长期血液透析或再次移植的个体。其产生原因是受者体内预先存在抗供者同种异型抗原（HLA、ABO血型和血小板抗原等）的抗体。在移植术后，这些抗体与移植物细胞表面相应抗原结合，激活补体，导致移植物的血管内凝血和血栓形成，使移植器官发生不可逆性缺血、变性和坏死。掌握“移植免疫”知识点。